黏膜支持式义齿
A. （牙合）力通过卡环传导到基牙上
B. （牙合）力通过（牙合）支托传导到基牙上
C. （牙合）力通过（牙合）支托传导到黏膜和牙槽骨上
D. （牙合）力通过基托传导到基牙上
E. （牙合）力通过基托传导到黏膜和牙槽骨上

正确答案：E。（牙合）力通过基托传导到黏膜和牙槽骨上

解析：黏膜支持式义齿仅由基托和人工牙及无（牙合）支托的卡环组成。（牙合）力通过基托直接传递到黏膜和牙槽骨上；适用于多数牙缺失，余留牙松动，或因咬合过紧无法磨出（牙合）支托位置者。掌握“局部义齿类型，肯氏分类及模型观测”知识点。